妊娠足月胎位下移，腰腹阵痛，有便意或见红者，是
A. 临产
B. 试胎
C. 弄胎
D. 分娩
E. 以上均非

正确答案：A。临产

解析：临产的主要证候表现有宫底下降，腹坠腰酸，大小便次数增加，子宫颈口及阴道排出的分泌物增加，胎动减少，出现频繁的、不规则的阵痛，见红（A对）。妊娠八九个月时，或腹中痛，痛定仍如常者，称之试胎（B错）。若月数已足，腹痛或作或止，腰不痛者，此名“弄胎”。即在产程正式发动的前一段时间内，可出现间隔与持续时间不恒定、强度不增加的“假阵缩”（C错）。分娩主要包括三个过程：一、宫口扩张期，此时子宫出现规律性宫缩直至宫口打开10厘米左右；二、胎儿娩出期；三、胎盘娩出期（D错）。